患儿，9岁，发热。体温38.1℃，微恶寒，右侧耳下腮部漫肿，舌苔薄黄，脉浮数。其治法是
A. 疏风清热，散结消肿
B. 清利少阳，和解退热
C. 清肝泻火，解毒消肿
D. 清气凉营，解毒活血
E. 清热解毒，软坚散结

正确答案：A。疏风清热，散结消肿

解析：患儿发热伴腮部漫肿，当属流行性腮腺炎，全身症状不明显可诊断为邪犯少阳证。邪毒侵犯足少阳胆经，邪毒循经上攻腮颊，与气血相搏，凝滞于耳下腮部，则致腮部肿胀疼痛，邪毒郁于肌表，则致发热恶寒，舌苔薄黄，脉浮数均为邪犯少阳之象，治以疏风清热，散结消肿（A对）。清利少阳，和解退热适于伤寒少阳证（B错）。清肝泻火，解毒消肿适于脓耳肝胆火盛者（C错）。清气凉营，解毒活血适于邪炽气营且有瘀血的病症（D错）。清热解毒，软坚散结适于热毒壅盛的流行性腮腺炎（E错）。